有关病毒性肝炎，下列选项错误的是
A. 甲肝主要通过粪-口途径传播
B. 乙肝和丙肝的传播途径类似
C. HBV和HDV易发生协同感染
D. HEV经水传播不易实现
E. 通过主动和被动免疫可有效阻断乙肝的母婴传播

正确答案：D。HEV经水传播不易实现

解析：本题考查病毒性肝炎的相关内容。戊肝常为水型流行（D错，为本题正确答案），主要是粪便污染水源所致，是人源戊肝最为常见的传播模式。甲肝主要通过粪-口途径传播（A对），常见的传播途径有：经食物传播、经水传播和日常生活接触传播。乙肝和丙肝的传播途径类似（B对），有经血传播、母婴传播、性接触传播和日常生活接触传播。HBV和HDV易发生协同感染（C对）。通过主动和被动免疫可有效阻断乙肝的母婴传播（E对）。